既清热解毒，又祛风燥湿止痒的药是
A. 穿心莲
B. 白鲜皮
C. 土茯苓
D. 半边莲
E. 紫花地丁

正确答案：B。白鲜皮